三叉神经损伤后会引起
A. 咀嚼肌瘫痪
B. 面部触觉和痛觉丧失
C. 角膜反射丧失
D. 以上均是
E. 以上均无

正确答案：D。以上均是

解析：因三叉神经的特殊内脏运动纤维支配咀嚼肌运动；躯体感觉纤维传导头面部皮肤、口鼻腔黏膜等的痛、温、触觉；角膜反射刺激通过三叉神经眼支传入，故三叉神经损伤后会引起咀嚼肌瘫痪（A对）、面部触觉和痛觉丧失（B对）、角膜反射丧失（C对）。故D为本题正确答案。